鳃裂囊肿作穿刺抽吸时可见
A. 草绿色液体
B. 透明、淡黄色水样液体
C. 黄色或棕色的、清亮的液体
D. 乳白色豆渣样分泌物
E. 血性液体

正确答案：C。黄色或棕色的、清亮的液体

解析：鳃裂囊肿作穿刺抽吸时，可见有黄色或棕色的、清亮的、含或不含胆固醇的液体。掌握“甲状舌管囊肿及鳃裂囊肿”知识点。